某女，86岁。体瘦，患支气管哮喘20年，时而喘息，动则加重，证属下元虚冷、肾不纳气之虚喘。日前因不慎着凉，又患胃寒呕吐。治当温中止呕，温肾纳气，宜选用的药是
A. 薤白
B. 甘松
C. 沉香
D. 香附
E. 川棟子

正确答案：C。沉香

解析：本题考查的是沉香的功效。患支气管哮喘20年，时而喘息，动则加重，证属下元虚冷、肾不纳气之虚喘。日前因不慎着凉，又患胃寒呕吐。治当温中止呕，温肾纳气，宜选用的药是沉香（C对）。沉香：【功效】行气止痛，温中止呕，温肾纳气。薤白（A错）：【功效】通阳散结，行气导滞。甘松（B错）：【功效】行气止痛，开郁醒脾。香附（D错）：【功效】疏肝理气，调经止痛。川楝子（E错）：【功效】行气止痛，杀虫，疗癣。